可与碱性酒石酸铜反应生成沉淀的是
A. 维生素B₁
B. 硫酸阿托品
C. 磺胺甲噁唑
D. 布洛芬
E. 葡萄糖

正确答案：E。葡萄糖

解析：本题考查葡萄糖的鉴别反应。葡萄糖（E对）的醛基具有还原性，在碱性条件下可将铜离子还原，生成红色的氧化铜沉淀。